具有五环吗啡结构的镇痛药是
A. 吗啡
B. 美沙酮
C. 哌替啶
D. 盐酸溴己新
E. 羧甲司坦

正确答案：A。吗啡

解析：本题考查吗啡。具有五环吗啡结构的镇痛药是吗啡（A对）。吗啡是由5个环（A、B、C、D、E）稠和而成的复杂结构，吗啡作用于阿片受体，产生镇痛、镇咳、镇静作用。临床上主要用于抑制剧烈疼痛，亦用于麻醉前给药。美沙酮（B错）为阿片受体非环状配体，临床上主要用于海洛因成瘾的脱毒治疗。哌替啶（C错）只保留了吗啡结构的A环和D环，可以；看做吗啡碱A、D环类似物，主要作用于中枢神经系统，对心血管、平滑肌亦有一定影响，毒副作用也相应较小。盐酸溴己新（D错）是具有苯甲胺结构的祛痰药，可直接作用于支气管腺体，促使黏液分泌细胞的溶酶体释出，使痰中的黏多糖纤维分化裂解。羧甲司坦（E错）是具有氨基酸结构的祛痰药，主要用于慢性支气管炎、支气管哮喘等疾病引起的痰液黏稠、咳痰困难和痰阻塞气管等病的治疗。